可引起女子乳房男性化和性功能障碍的药物是
A. 糖皮质激素
B. 呋塞米
C. 甘露醇
D. 氢氯噻嗪
E. 螺内酯

正确答案：E。螺内酯

解析：本题考查螺内酯的不良反应。可引起女子乳房男性化和性功能障碍的药物是螺内酯（E对）。糖皮质激素（A错）的不良反应包括医源性肾上腺皮质功能亢进、诱发或加重感染、消化系统、心血管系统并发症、骨质疏松、肌肉萎缩、糖尿病等。呋塞米（B错）的不良反应包括水与电解质紊乱、耳毒性、高尿酸血症等。甘露醇（C错）的不良反应少见，注射过快时可引起一过性头痛、眩晕、畏寒和视力模糊。氢氯噻嗪（D错）的不良发应包括电解质紊乱、高尿酸血症，导致高血糖、高血脂症及过敏反应等。